使相应细菌裂解的噬茵体称为
A. 温和噬菌体
B. 毒性噬菌体
C. 前噬菌体
D. 溶原性细菌
E. L型细菌

正确答案：B。毒性噬菌体

解析：毒性噬菌体在宿主菌体内复制增殖，产生许多子代噬菌体，并最终裂解细菌。掌握“噬菌体性状及分类”知识点。